下列具有清热生津，止呕，除烦功效的药物是
A. 大青叶
B. 鱼腥草
C. 夏枯草
D. 蒲公英
E. 芦根

正确答案：E。芦根

解析：该题考查芦根的功效，属记忆内容。芦根味甘，性寒；入肺、胃经；具有清热泻火，生津止渴，除烦，止呕，利尿的功效（E对ABCD错）。